男，52岁。上腹部疼痛反复发作5年，近7天出现腹胀，呕吐。经X线钡剂检查诊断十二指肠溃疡伴幽门梗阻。最适宜的手术方式是
A. 胃空肠吻合术
B. 毕II式手术
C. 毕I式手术
D. 迷走神经干切断术
E. 选择性胃迷走神经切断术

正确答案：B。毕II式手术

解析：十二指肠溃疡首选术式毕2手术（B对），因为其不仅吻合口张力不大，且溃疡发生率低。胃空肠吻合术（A错）一般用于预防胆汁、胰液的反流。毕1式（C错）一般是胃溃疡的首选术式，对于胃酸高的十二指肠溃疡不适用。迷走神经干切断术（D错）、选择性胃迷走神经切断术（E错）现在如今已较少应用。